霍奇金淋巴瘤化疗首选的方案是
A. MP方案
B. CHOP方案
C. ABVD方案
D. VDP方案
E. DA方案

正确答案：C。ABVD方案

解析：八版内科学认为霍奇金淋巴瘤化疗首选的方案是ABVD方案，MOPP方案（C错）是ABVD方案出现之前的首选化疗方案。MP方案（A错）是多发性骨髓瘤的传统化疗方案；CHOP方案（P590）（B错）是侵袭性非霍奇金淋巴瘤的标准化疗方案；VDP方案（P575）（D错）是急性淋巴细胞白血病常用化疗方案；DA方案（P576）（E错）是急性髓系白血病最常用的化疗方案。按九版内科学观点，本题无正确答案，原答案为C。